血府逐瘀汤除了活血化瘀外，还具有的功用是
A. 散结止痛
B. 温经止痛
C. 补气通络
D. 行气止痛
E. 疏肝通络

正确答案：D。行气止痛

解析：本题考查血府逐瘀汤的功用。血府逐瘀汤为理血剂，具有活血化瘀，行气止痛之功效。主治胸中血瘀证。胸痛，头痛，日久不愈，痛如针刺而有定处，或呃逆日久不止，或饮水即呛，干呕，或内热瞀闷，或心悸怔忡，失眠多梦，急躁易怒，入暮潮热，唇暗或两目暗黑，舌质暗红，或舌有瘀斑、瘀点，脉涩或弦紧（D对）。